半固体培养基便于观察细菌是否有下列哪种结构
A. 菌毛
B. 鞭毛
C. 荚膜
D. 芽胞
E. 磷壁酸

正确答案：B。鞭毛